以下关于人工喂养的描述中，最为恰当的一项是
A. 母亲因各种原因不能喂哺＜6个月婴儿时，完全采用牛乳、羊乳、其他兽乳或配方奶等喂哺
B. 母亲因各种原因不能喂哺＜2岁的小儿时，完全采用牛乳、羊乳、其他兽乳或配方奶等喂哺
C. 人工喂养婴儿（尤其是6个月以下的婴儿）最适宜的天然食物
D. 应大力提倡人工喂养
E. 牛乳易于消化

正确答案：A。母亲因各种原因不能喂哺＜6个月婴儿时，完全采用牛乳、羊乳、其他兽乳或配方奶等喂哺

解析：母亲因各种原因不能喂哺＜6个月婴儿时，完全采用牛乳、羊乳、其他兽乳或配方奶等喂哺，称为人工喂养。母乳是婴儿（尤其是6个月以下的婴儿）最适宜的天然食物，对婴儿的健康生长发育有不可替代的作用。应大力提倡母乳喂养，宣传母乳喂养的优点。掌握“婴儿喂养方法”知识点。